某女，32岁，口舌生疮，烦躁焦虑，口干舌燥，小便短赤。舌尖红，苔薄黄，脉数。脉数主病是
A. 虚证
B. 热证
C. 阴证
D. 寒证
E. 表证

正确答案：B。热证

解析：本题考查的是数脉与主病。脉数主病是热证（B对）。数脉与主病：［脉象］一息脉来五至以上（相当于每分钟脉搏在90次以上），“去来促急”。［主病］主热证。有力为实热，无力为虚热。虚证（A错）为细脉的主病。细脉与主病：［脉象］脉来细小如线，软弱无力，但应指明显。［主病］气血两虚、诸虚劳损，又主湿病。阴证（C错）在临床常表现为无热恶寒，四肢逆冷，息短气乏，身体沉重，精神不振，但欲卧寐，呕吐，下利清谷，小便色白，爪甲色青，面白舌淡，脉沉微等症状。寒证（D错）为迟脉的主病。迟脉与主病：［脉象］脉来迟慢，一息不足四至（相当于每分钟脉搏在60次以下）。［主病］主寒证。有力为冷积，无力为阳虚。表证（E错）为浮脉的主病。浮脉与主病：［脉象］“举之有余，按之不足”。轻取即得，重取稍弱。特点是脉象显现部位表浅。［主病］浮脉主表。浮而有力为表实，浮而无力为表虚。